构成传染病流行过程的基本单位是
A. 疫点
B. 疫区
C. 疫源地
D. 传染源
E. 社区

正确答案：C。疫源地

解析：本题考查构成传染病流行过程的基本单位。疫源地（C对ABDE错）是指传染源及其排出的病原体向周围播散所能波及的范围。它是构成传染病流行过程的基本单位。